某男，59岁。近3年经常眩晕，头胀头痛，昨日突发口眼㖞斜，舌强，语言不利，半身不遂；舌红苔黄，脉弦。诊断为中风。宜选用的基础方剂是
A. 真方白丸子
B. 血府逐瘀汤
C. 补阳还五汤
D. 天麻钩藤饮
E. 通窍活血汤

正确答案：D。天麻钩藤饮

解析：本题考查中风之风阳上扰证的方剂应用。患者诊断为中风之风阳上扰证，宜选用的基础方剂是天麻钩藤饮（D对）。中风之风阳上扰证【症状】平素头晕头痛，耳鸣目眩，突然发生口眼㖞斜，舌强语謇，或手足重滞，甚则半身不遂。舌质红苔黄，脉弦。【方剂应用】基础方剂：天麻钩藤饮（天麻、钩藤、生石决明、川牛膝、桑寄生、杜仲、栀子、黄芩、益母草、朱茯神、夜交藤）加减。中风之风痰入络证【症状】肌肤不仁，手足麻木，突然发生口眼㖞斜，语言不利，口角流涎，舌强语謇，甚则半身不遂，或兼见手足拘挛，关节酸痛等症。舌苔薄白，脉浮数。【方剂应用】基础方剂：真方白丸子（A错）（半夏、白附子、天南星、天麻、川乌、全蝎、木香、枳壳）加减。胁痛之瘀血阻络证【症状】胁肋刺痛，痛有定处，痛处拒按，入夜痛甚，胁肋下或见有积块。舌质紫暗，脉沉涩。【方剂应用】基础方剂：血府逐瘀汤（B错）（当归、生地黄、桃仁、红花、枳壳、赤芍、柴胡、川芎、桔梗、牛膝、甘草）或复元活血汤（柴胡、栝楼根、当归、红花、甘草、穿山甲、大黄、桃仁）加减。中风之气虚血瘀证【症状】肢体偏枯不用，肢软无力，面色萎黄。舌质淡紫或有瘀斑，苔薄白，脉细涩或细弱。【方剂应用】基础方剂：补阳还五汤（C错）（黄芪、当归、川芎、桃仁、红花、赤芍、地龙）加减。头痛之瘀血头痛【症状】头痛经久不愈，痛处固定不移，痛如锥刺，或有头部外伤史。舌紫暗，或有瘀斑，瘀点，苔薄白，脉细或细涩。【方剂应用】基础方剂：通窍活血汤（E错）（赤芍、川芎、桃仁、红花、麝香、老葱、鲜姜、枣、酒）加减。